与解剖式人工牙比较，非解剖式人工牙
A. 咀嚼效能差，侧向力大
B. 咀嚼效能差，侧向力小
C. 咀嚼效能好，侧向力大
D. 咀嚼效能好，侧向力小
E. 无差别

正确答案：B。咀嚼效能差，侧向力小

解析：非解剖式牙：牙尖斜度为0°，又称无尖牙，颊、舌轴面与解剖式牙类似。（牙合）面有溢出沟，咀嚼效能较差，侧向（牙合）力小，对牙槽骨的损害小。掌握“局部义齿人工牙及基托”知识点。